治疗不寐痰热内扰证，应首选
A. 黄连温胆汤
B. 朱砂安神丸
C. 安神定志丸
D. 黄连阿胶汤
E. 甘麦大枣汤

正确答案：A。黄连温胆汤

解析：不寐痰热内扰证为湿食生痰，郁痰生热，扰动心神所致，治宜清化痰热，和中安神，首选黄连温胆汤（A对）。朱砂安神丸功能清心降火，重镇安神，适用于阴虚不足，虚火亢盛，惊悸怔忡，心神烦乱，失眠多梦等症（B错）。安神定志丸功能重镇安神，常合酸枣仁汤治疗不寐心胆气虚证（C错）。黄连阿胶汤功能滋阴降火，养心安神，适用于阴虚火旺及热病后之心烦失眠（D错）。甘麦大枣汤功能养心安神，和中缓急，主治脏躁，为郁证忧郁伤神证的选方（E错）。